下列有关病历资料复印说法不恰当的是
A. 复印或者复制病历资料时，无需患者在场
B. 患者有权复印或者复制自己的门诊病历、住院志
C. 医疗机构应当提供复制的病历资料上加盖证明印记
D. 患者有权复制自己手术同意书、手术及麻醉记录单、病理资料
E. 医疗机构应患者的要求为其复印病历资料，可以按照规定收取工本费

正确答案：A。复印或者复制病历资料时，无需患者在场

解析：复印或者复制病历资料时，应当有患者在场。医疗机构应患者的要求，为其复印或者复制病历资料，可以按照规定收取工本费。掌握“医疗事故处理概述、预防与处置”知识点。